可致老年人出现脱水、低血钾不良反应的药品是
A. 甲基多巴
B. 螺内酯
C. 硝苯地平
D. 氢氯噻嗪
E. 格列齐特

正确答案：D。氢氯噻嗪